对于较大需手术切除的妊娠期龈瘤，手术时机应选择在
A. 妊娠期1个月以内
B. 妊娠期2～3个月
C. 妊娠期4～6个月
D. 妊娠期6～8个月
E. 妊娠期9个月

正确答案：C。妊娠期4～6个月

解析：本题考查妊娠期龈瘤的手术治疗。对于较大需手术切除的妊娠期龈瘤，手术时机应选择在妊娠期4～6个月（C对）。妊娠期龈炎通常始发于妊娠第三个月，8个月时达到高峰，分娩后2个月，龈炎可减轻至妊娠前水平。妊娠期1个月以内或2～3个月易导致流产（AB错），妊娠期6～8个月或9个月易导致早产（DE错），手术尽量选择在4～6个月。